医务人员之间相互协作的基础是
A. 尊重
B. 竞争
C. 平等
D. 信任
E. 独立

正确答案：D。信任

解析：在医师之间，只有相互尊重、互相信任，才能得到患者的尊重，密切合作，信任是相互协作的基础（D对A错）。求同存异，公平竞争是医师之间关系的道德要求（B错）。平等交往、一视同仁是医务人员处理医患关系时应该遵守的重要准则（C错）。相对独立型是医师与护士之间关系的道德要求（E错）。